属于第一代头孢菌素，可用于围术期预防感染的抗菌药物是
A. 头孢噻肟
B. 头孢哌酮
C. 头孢唑林
D. 头孢曲松
E. 头孢美唑

正确答案：C。头孢唑林

解析：本题考查头孢类抗菌药物的分类及应用。头孢唑林（C对）为第一代头孢菌素，可用于围术期预防感染。头孢噻肟（A错）、头孢哌酮（B错）、头孢曲松（D错）均为第三代头孢菌素。头孢美唑（E错）是一种半合成的头霉素衍生物，抗菌性能与第二代头孢菌素相近。